下列哪项是蔬菜和水果的共同特点
A. 不含膳食纤维
B. 不含有机酸
C. 维生素含量少
D. 含有有机酸和芳香物质
E. 蛋白质含量丰富

正确答案：D。含有有机酸和芳香物质